下列毒物最易经皮肤吸收并引起中毒的是
A. 苯
B. 汞
C. 苯胺
D. 一氧化碳
E. 氯乙烯

正确答案：C。苯胺